能指出疼痛部位病症有以下几种，除外
A. 急性根尖脓肿
B. 急性龈乳头炎
C. 急性牙髓炎
D. 牙本质敏感
E. 急性牙周脓肿

正确答案：C。急性牙髓炎

解析：本题考查急性牙髓炎的疼痛特点。急性牙髓炎（C错，为本题的正确答案）疼痛发作时，患者大多不能明确指出患牙所在，且疼痛呈放散性或牵涉性，多是由于牙髓神经纤维缺乏定位感受器所致。急性根尖脓肿（A对）累及根尖周的牙周膜，急性牙周脓肿（E对）累及牙颈部牙周膜，急性龈乳头炎（B对）累及龈乳头下方的牙周膜，而牙周膜中有丰富的神经和末梢感受器，对疼痛和压力、轻叩和震动都有敏锐的感觉，当疾病累及牙周膜患有疼痛时能指出患牙所在，所以急性根尖脓肿、急性牙周脓肿、急性龈乳头炎均能指出疼痛部位。牙本质敏感（D对）在接受冷热酸甜刺激时引发牙本质小管内液体发生多向流动。这种流动传到牙髓，会引起牙髓神经纤维的兴奋而产生痛觉，这种疼痛可牵涉牙周膜，疼痛可定位。